口服四环素治疗青少年牙周炎，除了其抑菌作用外，还能
A. 抑制胶原酶的活性
B. 抑制前列腺素合成
C. 抑制前列腺素释放
D. 抑制细菌代谢产物的毒性
E. 延缓细菌在获得性膜的粘附作用

正确答案：A。抑制胶原酶的活性

解析：本题考查四环素药物的作用。四环素药物能抑制胶原酶及其他金属蛋白酶的活性（A对），结缔组织破坏，阻断骨的吸收，促进牙周组织再生。四环素族药物对多种牙周可疑致病菌都有抑制作用，局限性青少年牙周炎刮治后应用四环素族药物可有效地抑制组织内细菌的繁殖但不能抑制细菌代谢产物的毒性（D错），也不能延缓细菌在获得性膜的粘附作用（E错）。非甾体抗炎药物治疗牙周炎可能的机制：抑制前列腺素的合成（B错），抑制前列腺素释放（C错）来减轻组织的炎症，减轻牙槽骨的吸收。